某女，49岁。近1年月经周期紊乱，几天前因心情抑郁，遂致失眠、心烦、焦虑、健忘。证属情志不畅、肝郁气滞，宜选用的成药是
A. 解郁安神颗粒
B. 逍遥颗粒
C. 朱砂安神丸
D. 枣仁安神液
E. 养血安神丸

正确答案：A。解郁安神颗粒

解析：本题考查的是解郁安神颗粒的主治。近1年月经周期紊乱，几天前因心情抑郁，遂致失眠、心烦、焦虑、健忘。证属情志不畅、肝郁气滞，宜选用的成药是解郁安神颗粒（A对）。解郁安神颗粒：【主治】情志不畅、肝郁气滞所致的失眠、心烦、焦虑、健忘；神经官能症、更年期综合征见上述证候者。逍遥颗粒（B错）：【主治】肝郁脾虚所致的郁闷不舒、胸胁胀痛、头晕目眩、食欲减退、月经不调。朱砂安神丸（C错）：【主治】心火亢盛、阴血不足证，症见心神烦乱、失眠多梦、心悸不宁、舌尖红、脉细数。枣仁安神液（D错）：【主治】心血不足所致的失眠、健忘、心烦、头晕；神经衰弱症见上述证候者。养血安神丸（E错）：【主治】阴虚血少所致的头眩心悸、失眠健忘。